患者，男，72岁，高血压病史20年，突发右上肢无力2小时，诊断为非心源性栓塞缺血性脑卒中。关于该疾病急性期治疗的说法，正确的是
A. 立即给予依诺肝素钠注射液4000IU阿司匹林应在溶栓24小时后开始使用
B. 立即给予注射用阿替普酶0.5mg/kg（最大剂量为50mg)
C. 血压≥140/90mmHg时应积极控制血压
D. 立即给予甘露醇注射液250ml
E. 阿司匹林应在溶栓24小时后开始使用

正确答案：E。阿司匹林应在溶栓24小时后开始使用

解析：本题考查缺血性脑卒中急性期的治疗。对于不符合静脉溶栓或血管内取栓适应证且无禁忌证的缺血性脑卒中患者应在发病后尽早给予口服阿司匹林150～300mg/d治疗。急性期后可改为预防剂量（50～150mg/d）。溶栓治疗者，阿司匹林等抗血小板药物应在溶栓24小时后开始使用（E对）；如果患者存在其他特殊情况（如合并疾病），评估获益大于风险后可以考虑在阿替普酶静脉溶栓24小时内使用抗血小板药物。